临产后的胎心监护错误的是
A. 听胎心应在宫缩间歇期宫缩刚结束时
B. 潜伏期应每小时听胎心一次
C. 活跃期应每30分钟听胎心一次
D. 第二产程应每15分钟听胎心一次
E. 胎心每次应听1分钟

正确答案：D。第二产程应每15分钟听胎心一次

解析：胎心听取应在宫缩间歇期宫缩刚结束时（A对），潜伏期应隔1～2小时听胎心一次（B对），活跃期应每15～30分钟听胎心一次（C对），每次听诊1分钟（E对）。根据八版妇产科学：第二产程每5～10分钟听胎心一次；根据九版妇产科学：第二产程每次宫缩过后或每5分钟监测一次（D错，为本题正确答案）。